男婴，10个月。4天前无明显诱因出现发热，体温持续在38℃～39.6℃，应用退热药后可短暂下降，1天前体温恢复正常，皮肤出现皮疹。查体：T36.5℃，颜面、颈部及躯干可见小红色斑丘疹，咽红。其最可能的诊断是
A. 幼儿急疹
B. 风疹
C. 麻疹
D. 水痘
E. 猩红热

正确答案：A。幼儿急疹

解析：患儿，10个月，4天前无明显诱因出现发热，体温持续在38℃～39.6℃（体温正常值36℃～37.3℃），1天前体温恢复正常后，皮肤出现皮疹。查体：T36.5℃，颜面、颈部及躯干可见小红色斑丘疹，咽红。高热4～5天，热退疹出是幼儿急疹的典型特征。综合患者临床表现和体征，考虑诊断为幼儿急疹（A对）。风疹（B错）全身症状轻，耳后、枕后淋巴结肿大并触痛，皮疹多在症状出现后1～2天出现，且有面颈部→躯干→四肢的先后顺序，故该患儿不考虑此病。麻疹（C错）为发热3～4天后出疹，且出疹期间热度更高，全身症状重。水痘（D错）为低热1天后出疹。猩红热（E错）常有草莓舌的临床表现，且发热1～2天后就出疹（该患儿发热4天才出疹），出疹时高热。